原发性肾小球疾病的临床分类不包括
A. 慢性肾小球肾炎
B. 肾盂肾炎
C. 急进性肾小球肾炎
D. 肾病综合征
E. 无症状性血尿（和）蛋白尿

正确答案：B。肾盂肾炎

解析：原发性肾小球疾病的临床分类包括：急性肾小球肾炎、急进性肾小球肾炎（C对）、慢性肾小球肾炎（A对）、无症状性血尿（和）蛋白尿（E对）和肾病综合征（D对）。肾盂肾炎（B错，为本题正确答案）主要表现为局限或广泛肾盂、肾盏黏膜充血。肿胀，肾间质水肿，但肾小球一般无形态学改变。